天南星炮制成胆南星后，其功效变化是
A. 由温化寒痰转为清化热痰
B. 由祛风止痉转为燥湿化痰
C. 由燥湿化痰转为息风定惊
D. 由温化寒痰转为燥湿化痰
E. 由清化热痰转为燥湿化痰

正确答案：A。由温化寒痰转为清化热痰

解析：本题考查天南星炮制作用。天南星【炮制作用】天南星味苦，辛，性温；有毒。归肺、肝、脾经。①生天南星辛温燥烈，有毒，多外用。亦可内服，以祛风止痉为主，多用于破伤风，也用于癫痫。外用治痈肿疮疖，蛇虫咬伤。②制南星毒性降低，燥湿化痰的作用增强。③胆南星毒性降低，其燥烈之性缓和，药性由温转凉，味由辛转苦，功能由温化寒痰转为清化热痰（A对）。以清化热痰，息风定惊力强，多用于痰热咳喘、急惊风、癫痫等。